下列哪项不属于无芽胞厌氧菌的致病条件
A. 皮肤黏膜屏障破坏
B. 机体组织局部坏死造成厌氧微环境
C. 菌群失调
D. 机体免疫力降低
E. 肿瘤

正确答案：E。肿瘤

解析：无芽胞厌氧菌的致病条件：①机体受机械或病理性损伤，使皮肤黏膜屏障被破坏；②机体组织局部坏死、缺血，存留异物或与需氧菌共生感染，造成局部厌氧微环境；③菌群失调；④各种因素引起机体免疫力降低。掌握“无芽胞厌氧菌”知识点。